以下哪种疾病的光镜特点为细胞形态的一致性、组织结构的多样性及浸润性生长
A. 多形性腺瘤
B. 沃辛瘤
C. 圆柱瘤
D. 多形性低度恶性腺癌
E. 黏液表皮样癌

正确答案：D。多形性低度恶性腺癌

解析：光镜观察，多形性低度恶性腺癌的特征是细胞形态的一致性、组织结构的多样性及浸润性生长方式。掌握“多形性低度恶性腺癌”知识点。